倾向因素包括
A. 知识、态度、价值观
B. 知识、行为意向成分、态度、价值观
C. 知识、信念、态度、价值观
D. 知识、信念、情感、态度、价值观
E. 知识、信念、认同感、态度、价值观

正确答案：C。知识、信念、态度、价值观